印度博帕尔农药厂爆炸泄漏事故中，所泄漏的剧毒物质是
A. 氰化氢
B. 硫化氢
C. 甲基异氢酸酯
D. 苯系化合物
E. 高浓度一氧化碳

正确答案：C。甲基异氢酸酯

解析：本题考查印度博帕尔农药厂爆炸泄漏事故的剧毒物质。印度博帕尔农药厂爆炸泄漏事故中，所泄漏的剧毒物质是甲基异氢酸酯（C对ABDE错）。